当前谈及的医学模式转变是指
A. 从神灵主义医学模式转向自然哲学医学模式
B. 从生物医学模式转向生物-心理-社会医学模式
C. 从自然哲学医学模式转向生物-心理-社会医学模式
D. 从机械论医学模式转向生物-心理-社会医学模式
E. 从自然哲学医学模式转向机械论医学模式

正确答案：B。从生物医学模式转向生物-心理-社会医学模式

解析：本题考查医学模式的转变。当前谈及的医学模式转变是指从传统的生物医学模式转向生物-心理-社会医学模式（B对ACDE错）。